可能引起宫颈癌的病原体是
A. 单纯疱疹病毒
B. 沙眼衣原体
C. 淋病双球菌
D. 解脲支原体
E. 风疹病毒

正确答案：A。单纯疱疹病毒